男，28岁，建筑工人。下午3时露天工作时发生大汗、头痛、腹痛、呕吐、抽搐，无尿、便失禁，流涎，口吐白沫。当日最高气温38℃，既往体健。查体：T38.1℃，心率106次/分，血压90/60mmHg。神志清楚，面色潮红，双肺未闻及干湿啰音，心律齐。最可能的诊断为
A. 热衰竭
B. 热射病
C. 热痉挛
D. 低血糖
E. 脱水

正确答案：C。热痉挛

解析：青年男性患者，建筑工人。下午3时露天工作时（劳力工作）发生大汗、头痛、腹痛、呕吐、抽搐，无尿、便失禁，流涎，口吐白沫（热痉挛表现）。当日最高气温38℃，既往体健。查体：T38.1℃（高热），心率106次/分，血压90/60mmHg，神志清楚，面色潮红，双肺未闻及干湿啰音，心率齐，故患者诊断为热痉挛（C对）。热衰竭（A错）多见于老年人、儿童和慢性病病人，心率明显增快。热射病（B错）一般有高热＞40℃伴神志障碍。低血糖（D错）的症状通常表现为出汗、饥饿、心慌、颤抖、面色苍白等。露天工作导致的脱水（E错）往往是高渗性脱水，会有极度口渴的症状。